男性，60岁。咳嗽，偶尔痰中带血，胸片显示右上肺不张，右肺门肿块（直径4.0厘米）与右上肺不张影相连，呈“S”形。可诊断为
A. 肺结核
B. 肺炎
C. 肺脓肿
D. 中心型肺癌
E. 肺纤维化

正确答案：D。中心型肺癌

解析：患者为老年男性，咳嗽，偶痰中带血，胸片显示右上肺不张，右肺门肿块（直径4.0厘米）与右上肺不张影相连，呈“S”形征象，故可以诊断为中心型肺癌（D对）。肺结核（A错）的特点为咳嗽、咳痰，痰中带血或咯血，消瘦，乏力，盗汗。肺炎（B错）的特点为寒战、高热、咳嗽、咳痰、胸痛、呼吸困难。肺脓肿（C错）的表现为咳嗽，发热，咳吐大量脓臭痰，病变范围大者可出现气促、精神不振、乏力、纳差等全身中毒表现。肺纤维化（E错）的特点为咳嗽、咳痰、呼吸困难、紫绀等。